在有氧条件下可形成芽胞的细菌为
A. 军团菌
B. 铜绿假单胞菌
C. 炭疽杆菌
D. 大肠杆菌
E. 布氏杆菌

正确答案：C。炭疽杆菌

解析：炭疽芽胞杆菌，革兰氏染色阳性，呈两端平切，无鞭毛，在体内或含血清培养基中可形成荚膜，在有氧条件下可形成椭圆形芽胞，位于菌体中央且直径不大于菌体，呈竹节样排列的长链。掌握“动物源性细菌”知识点。